患者，男，61岁。1个月来，大便次数由每日1次变为每日2～3次，并有下坠及排便不尽之感，便中带血，色暗红、量不多。初步诊断为直肠癌，为确诊，应作哪项简便而有意义的检查
A. 结肠造影
B. 肛门直肠指诊
C. 美兰染色
D. 结肠镜检查
E. 病理切片

正确答案：B。肛门直肠指诊

解析：肛管直肠癌，中医称之为锁肛痔，是发生在肛管直肠的恶性肿瘤，病至后期，肿瘤阻塞，肛门狭窄，排便困难，其早期特点为便血、大便习惯改变，肛门直肠指诊，是诊断直肠癌的最重要方法，80%的直肠癌位于手指可触及的部位，可以清楚地扪到肠壁上的硬块、巨大溃疡或肠腔狭窄，简单易行（B对）。结肠造影和结肠镜检查适用于结肠部位病变（AD错）。美蓝染色适用于标本组织染色（C错）。病理切片，可确诊肛管直肠癌，但是在直肠镜或乙状结肠镜检查的基础上取活组织进行，较为复杂，不符合题意（E错）。